哪项不是传染病的潜伏期主要用途
A. 可作为判定致病因素的依据或作为确定传染病的隔离期限
B. 追溯传染源和确定传播途径
C. 评价防制措施的效果
D. 决定检疫期限

正确答案：A。可作为判定致病因素的依据或作为确定传染病的隔离期限

解析：本题考查潜伏期的流行病学意义。潜伏期的流行病学意义为：①根据潜伏期的长短判断病人受感染的时间，用于追溯传染源和确定传播途径（B对）。②根据潜伏期的长短确定接触者的留验、检疫（D对）和医学观察期限。③根据潜伏期的长短确定免疫接种的时间。④根据潜伏期来评价防制措施的效果（C对）。⑤潜伏期的长短会影响疾病的流行特征。潜伏期不可作为判定致病因素的依据或确定传染病的隔离期限（A错，为本题正确答案）。